当事人提交有关医疗事故鉴定材料应当自收到医学会的通知之日起
A. 3日内
B. 5日内
C. 7日内
D. 10日内
E. 15日内

正确答案：D。10日内

解析：当事人应当自收到医学会的通知之日起10日内提交有关医疗事故技术鉴定的材料、书面陈述及答辩。掌握“医疗事故的技术鉴定”知识点。